患者，男，52岁，2型糖尿病4年余，长期口服格列吡嗪。近期血糖控制不佳，考虑加用其他降糖药物，不宜联合使用的药物是
A. 西格列汀
B. 瑞格列奈
C. 二甲双胍
D. 阿卡波糖
E. 吡格列酮

正确答案：B。瑞格列奈

解析：本题考查联合用药。格列吡嗪与瑞格列奈（B错，为本题正确答案）均属于促胰岛素分泌剂，均能导致低血糖，不宜合用。